右心室有
A. 动脉圆锥
B. 梳状肌
C. 四个乳头肌
D. 主动脉前庭
E. 二尖瓣

正确答案：A。动脉圆锥

解析：动脉圆锥（A对）又称心室流出道，位于右心室内，呈圆锥体状，其上端借肺动脉口通肺动脉干。